我国卫生事业的性质趋向于
A. 生产性
B. 盈利性
C. 公益性
D. 福利性
E. 以上答案均不对

正确答案：C。公益性

解析：本题考查我国卫生事业的性质。我国卫生事业的性质趋向于公益性（C对ABDE错）。